十二指肠降部左后缘与胰头之间有
A. 肝总管
B. 胆总管
C. 胆囊管
D. 胰管
E. 肠管

正确答案：B。胆总管

解析：胆总管(B对)下行经十二指肠上部后方到十二指肠降部后方，此时后方为胰头，然后继续降至胰头后方再转至十二指肠降部中份。